服用丙戊酸钠的癫痫患者合用美罗培南后，可能引起癫痫发作的机制是
A. 诱导细菌对前者的耐药
B. 易发生交叉过敏反应
C. 两种药物会形成复合物沉淀
D. 促进前者在肝脏的代谢
E. 阻止后者在肾脏被灭活

正确答案：D。促进前者在肝脏的代谢

解析：本题考查药物相互作用。丙戊酸钠与美罗培南合用，导致自身在肝脏代谢增加（D对），血药浓度降低，癫痫失控的风险增加。